一婴儿诊断为散发性甲状腺功能减低症，不正确的治疗是
A. 应终身服用甲状腺片
B. 明确诊断后应立即治疗
C. 供给各种维生素及矿物质
D. 需加用碘剂治疗
E. 需供给充足的蛋白质

正确答案：D。需加用碘剂治疗

解析：散发性甲状腺功能减低症患者存在甲状腺激素生成不足或利用障碍，因此应当终生服用甲状腺制剂（AB对），饮食中应富含蛋白质、维生素及矿物质（CE对）。碘剂为合成甲状腺素的原料，但散发性甲减患者合成或利用甲状腺激素障碍，加用碘剂于治疗无意义（D错，为本题正确答案）。